酒蒸黄精，每100kg黄精用酒量为
A. 25kg
B. 20kg
C. 30kg
D. 10kg
E. 15kg

正确答案：B。20kg

解析：本题考查的是黄精的炮制方法。酒蒸黄精，每100kg黄精用酒量为20kg（B对）。黄精：【炮制方法】处方用名有黄精、酒黄精、蒸黄精。①黄精：取原药材，除去杂质，洗净，略润，切厚片，干燥。②酒黄精：取净黄精，加黄酒拌匀，置蒸制容器内，蒸透，或密闭隔水炖至酒被吸尽，色泽黑润，口尝无麻味时，取出，稍晾，切厚片，干燥。每100kg黄精，用黄酒20kg。③蒸黄精：取净黄精，置蒸制容器内，反复蒸至内外成滋润黑色，切厚片，干燥。100kg药材用酒10kg（D错）为酒黄芩的炮制辅料用量。酒黄芩：取黄芩片，加黄酒拌匀，稍闷，待黄酒被吸尽后，用文火炒至药物表面微干，深黄色，嗅到药物与辅料的固有香气，取出，晾凉。每100kg黄芩片，用黄酒10kg。